不属于上皮组织肿瘤的是
A. 胃淋巴瘤
B. 肝腺瘤
C. 宫颈鳞状细胞瘤
D. 肺腺瘤
E. 乳腺导管内乳头状瘤

正确答案：A。胃淋巴瘤

解析：上皮组织肿瘤：（1）良性：乳头状瘤（E错）、腺瘤（BD错）；（2）恶性：鳞状细胞癌（C错）、腺癌、基底细胞癌、尿路上皮癌。间叶组织肿瘤：（1）良性：脂肪瘤、血管瘤、淋巴管瘤、平滑肌瘤、软骨瘤；（2）恶性：脂肪肉瘤、横纹肌肉瘤、平滑肌肉瘤、血管肉瘤、纤维肉瘤、骨肉瘤、软骨肉瘤。胃淋巴瘤（A对）属于淋巴造血组织的肿瘤。